有关中耳错误的是
A. 位于外耳和内耳之间
B. 为一含气空腔，大部位于颞骨岩部
C. 包括鼓室、咽鼓管、乳突窦和乳突小房
D. 除平衡鼓膜内外大气压外，无其他重要功能
E. 无

正确答案：D。除平衡鼓膜内外大气压外，无其他重要功能

解析：中耳由鼓室、咽鼓管、乳突窦和乳突小房组成（C对），为一含气的不规则腔道，大部分位于颞骨岩部内（B对）。中耳向外借鼓膜与外耳道相隔，向内毗邻内耳（A对，故D为本题正确答案）。